治疗效果最差的骨下袋是
A. 一壁骨袋
B. 二壁骨袋
C. 三壁骨袋
D. 四壁骨袋
E. 混合壁骨袋

正确答案：D。四壁骨袋

解析：本题考查牙槽骨破坏的形式-垂直型吸收。牙周炎在不同的牙面和部位存在不同形式和程度的牙槽骨吸收，可分为水平型吸收和垂直型吸收，水平型通常形成骨上袋；垂直型吸收是发生垂直向或斜行的吸收，可根据骨质破坏后剩余的骨壁数目，分为一袋、二袋、三袋、四袋骨壁、混合壁袋，四袋骨壁治疗效果最差（D对），二袋骨壁（B错）和三袋骨壁（C错）手术最为适应，治疗效果较好。一壁骨袋牙槽骨破坏严重，仅存一侧骨壁，较四壁骨袋，牙根孤立的位于骨下袋中央相比，预后较四壁骨袋好（A错）。混合壁骨袋为牙槽骨的吸收在各个骨壁高度不同，根尖端骨壁数目一般多于冠端，预后较四壁骨袋好（E错）。